为失血性休克扩充血容量宜选用
A. 硫酸亚铁
B. 叶酸
C. 维生素B₁₂
D. 右旋糖酐
E. 红细胞生成素

正确答案：D。右旋糖酐